可以直接用于临床配方或者制剂生产的是
A. 中药配方颗粒
B. 中成药
C. 中药材
D. 中药饮片

正确答案：D。中药饮片

解析：本题考查中药的管理分类和内涵。可以直接用于临床配方或者制剂生产的是中药饮片（D对）。中药饮片既可根据中药处方直接调配煎汤（剂）服用，又可作为中成药生产的原料供制药厂使用。中药配方颗粒（A错）是由单味中药饮片经提取浓缩制成的、供中医临床配方用的颗粒。现代中成药（B错）是指以中药饮片为原料，在中医药理论指导下，按规定的处方和方法，加工制成一定的剂型，标明药物作用、规格、功能主治、剂量、服法、注意事项等，以供医生、患者直接选用。中药材（C错）是指对药材（生药）经过产地初加工后制成的中药。